计算5岁儿童的体重
A. 16kg
B. 18kg
C. 15kg
D. 21kg
E. 20kg

正确答案：B。18kg

解析：本题考查出生至青春前期的体格生长规律-体重的增长。计算5岁儿童的体重为18kg（B对）。1～6岁正常儿童体重的估计公式为：年龄（岁）✕2+8，所以5岁儿童的体重为18kg。